苯二氮䓬类镇静催眠药中毒时，特异性治疗药物是
A. 去甲肾上腺素
B. 苯甲酸钠咖啡因
C. 氟马西尼
D. 麻黄碱
E. 水杨酸毒扁豆碱

正确答案：C。氟马西尼

解析：本题考查苯二氮䓬类镇静催眠药中毒解救。苯二氮䓬类镇静催眠药中毒时，特异性治疗药物是氟马西尼（C对）。氟马西尼是特异的苯二氮䓬受体拮抗剂，能快速逆转昏迷。